下列不属于医学伦理学研究对象的是
A. 医务人员与患者之间的关系
B. 医务人员与医学发展之间的关系
C. 医务人员与其家庭成员间的关系
D. 医务人员与社会之间的关系
E. 医务人员相互之间的关系

正确答案：C。医务人员与其家庭成员间的关系

解析：医学伦理学以医疗卫生领域中的道德现象及其发展规律为主要的研究对象，研究对象主要包括医患关系（A对）、医医关系（E对）、医护关系、医务人员与医疗机构的关系（B对）、医疗机构之间的关系及医务人员与社会的关系（D对）等，但不包括医务人员与其家庭成员的关系（C错，为本题正确答案）。